等级资料两样本比较的秩和检验中，如相同秩次过多，应计算校正u值，校正的结果是
A. u值增大，P值减小
B. u值增大，P值增大
C. u值减小，P值增大
D. u值减小，P值减小
E. 视具体资料而定

正确答案：A。u值增大，P值减小